干髓术后发生残髓炎者，应进行什么治疗
A. 除去重填物重新失活后再行干髓术
B. 拔除患牙
C. 除去充填物、进行根管治疗或牙髓塑化疗法
D. 不除去充填物，只使用药物消炎
E. 除去充填物开放，服用止痛药物、症状消失后重新充填

正确答案：C。除去充填物、进行根管治疗或牙髓塑化疗法

解析：本题考查残髓炎的治疗。牙髓病的治疗原则是保留活髓和保存患牙。残髓炎是经牙髓治疗后的患牙，由于残留了少量炎症根髓造成的。其治疗方法为除去充填物、进行根管治疗或牙髓塑化疗法（C对），这样既能去除感染又能保留患牙。由于剩余的牙髓已发生感染，失活剂只能使活髓失活，而不能消除感染，因此除去重填物重新失活后再行干髓术（A错）不能控制感染，不可作为治疗方法。一般来说，残髓炎只要彻底清除感染，重新充填，完全可以保留患牙，若直接拔除患牙（B错）则违背了保存患牙的治疗原则。不除去充填物，只使用药物消炎（D错）无法根治，也不宜采用，目前尚未有药物可以穿透充填物达到感染牙髓达到消炎目的。另外，目前口服药物不可作为控制牙髓感染的主要方法，因为到达病灶的药物浓度过低，只能最为辅助，要彻底清除感染必须手术机械清除，除去充填物开放，服用止痛药物、症状消失后重新充填（E错）也不可作为治疗方法。